以下哪项是以均数为中心，左右两侧基本对称的中间多、两侧逐渐减少的重要连续型分布。
A. 正态分布
B. 偏态分布
C. 不规则分布
D. 线性分布
E. 点状分布

正确答案：A。正态分布

解析：正态分布是一种重要的连续型分布，以均数为中心，左右两侧基本对称，靠近均数两侧频数较多，离均数愈远，频数愈少，形成一个中间多、两侧逐渐减少、基本对称的分布。掌握“定量资料的统计描述和推断”知识点。